形成光化学烟雾的污染物是
A. SO₂、烟尘
B. O₂、NOₓ
C. NOₓ、碳氢化合物
D. CO、O₃、NOₓ
E. CO、O₃、NO

正确答案：C。NOₓ、碳氢化合物

解析：本题考查形成光化学烟雾的污染物。光化学烟雾是指在空气中，紫外线照射到污染物（如NOₓ、CO、碳氢化合物）上，使其发生化学反应，产生一系列有害物质，如臭氧、醛类等，从而形成光化学烟雾。因此，形成光化学烟雾的污染物是NOₓ、碳氢化合物（C对ABDE错）。